患儿，4岁。不能独立行走，全身无力，面色无华，舌淡苔薄白。其治法是
A. 补肺健脾
B. 补中益气
C. 补肾养肝
D. 益气养血
E. 温补肾阳

正确答案：D。益气养血

解析：患儿4岁而不能行走，当属五迟之行迟。五迟是小儿生长发育障碍的病症，五迟指立迟、行迟、齿迟、发迟、语迟，脾主四肢，为气血生化之源，脾气虚弱，气血不足，则见不能独立行走，全身无力、面色无华、舌淡苔薄白为气血虚弱之象，应益气养血（D对）。患儿以脾气虚弱为主，未见肺气虚弱之象，不需同补肺脾（A错）。患儿既有气虚，也有血虚，需气血双补，补中益气不够精确（B错）。若肝肾亏虚，应可见牙齿出迟，毛发稀疏干枯，筋骨失养等表现，患儿无肝肾亏虚表现，不需补肾养肝（C错）。若肾阳亏虚，应可见面色㿠白，畏寒，腰膝酸软等表现，患儿不属肾阳亏虚证型（E错）。